《中国药典》（一部）收载的内容包括
A. 药材
B. 饮片
C. 植物油脂和提取物
D. 单味制剂
E. 成方制剂

正确答案：A、B、C、D、E。药材；饮片；植物油脂和提取物；单味制剂；成方制剂

解析：本题考查《中国药典》的主要内容。中国药典一部主要收载的是药材（A对）、饮片（B对）、植物油脂和提取物（C对）、单味制剂（D对）、成方制剂（E对）。《中国药典》国务院药品监督管理部门颁布的《中国药典》和药品标准为国家药品标准。《中国药典》收载的品种须经过严格的医药学专家委员会进行遵选。主要收载我国临床常用、疗效肯定、质量稳定（工艺成熟）、质控标准较完善的品种。其他不能满足上述条件（包括上市时间较短）或有特殊情况的品种均收载于局颁或部颁标准。《中国药典》（一部）收载了药材和饮片、植物油脂和提取物、成方制剂和单味制剂的标准。